鉴别乌梢蛇性状特征的术语是
A. 虎牙
B. 大挺
C. 挂甲
D. 银皮
E. 剑脊

正确答案：E。剑脊

解析：本题考查的是乌梢蛇性状特征的术语。鉴别乌梢蛇性状特征的术语是剑脊（E对）。乌梢蛇的脊部“高耸成屋脊状”，俗称“剑脊”，可作为其性状特征。砍茸：花鹿茸为带头骨的茸，茸形与锯茸相同，亦分二杠或三岔等规格。两茸相距约7cm，脑骨前端平齐，后端有1对弧形骨，习称“虎牙”（A错）。花鹿茸：呈圆柱状分枝，具1个分枝者习称“二杠”，主枝习称“大挺”（B错）。牛黄水液可使指甲染黄，习称“挂甲”（C错）。毛壳麝香：内层皮膜呈棕色，内含颗粒状及粉末状的麝香仁和少量细毛及脱落的内层皮膜（习称“银皮”）（D错）。